女，28岁。发热、皮肤出血点2周。查体：贫血貌，四肢皮肤散在出血点，胸骨压痛（+），左肺可闻及少许湿啰音，腹软，脾肋下1cm。血常规：Hb71g/L，WBC3.0×10⁹/L，骨髓细胞检查见原始细胞比0.9，细胞化学染色：MPO（-），PAS（+），骨髓染色体检查为正常核型，应首选的治疗是
A. 全反式维A酸口服液
B. VDLP方案化疗
C. 甲磺酸伊马替尼口服
D. DA方案化疗
E. 环孢素口服

正确答案：B。VDLP方案化疗

解析：患者青年女性，发热、皮肤出血点2周。查体：贫血貌，四肢皮肤散在出血点，胸骨压痛（+），左肺可闻及少许湿啰音，腹软，脾肋下1cm（脾肿大）。血常规：Hb71g/L（女性正常值为110～150g/L），WBC3.0×10⁹/L（正常值为（4～10）×10⁹/L）），骨髓细胞检查见原始细胞比0.9，细胞化学染色：MPO（-），PAS（+），骨髓染色体检查为正常核型，根据患者病史、体查及实验室检查，可考虑诊断为急性淋巴细胞白血病，首选的治疗措施是VDLP方案化疗（B对）。全反式维A酸口服液（A错）是急性早幼粒细胞白血病的首选治疗方案。甲磺酸伊马替尼口服（C错）是慢性髓系白血病的首选治疗方案。DA方案化疗（D错）是急性髓系白血病的首选治疗方案。环孢素口服（E错）是慢性淋巴细胞白血病的药物。